可作为粉末直接压片的“干黏合剂”使用的辅料是
A. 羟丙基甲基纤维素
B. 硫酸钙
C. 微晶纤维素
D. 淀粉
E. 糖粉

正确答案：C。微晶纤维素

解析：本题考查片剂的常用辅料。微晶纤维素（C对）（MCC）具有良好的结合力与良好的可压性，亦有“干黏合剂”之称，可用作粉末直接压片。羟丙基甲基纤维素（A错）常用作片剂的黏合剂。硫酸钙（B错）为无机盐类填充剂，不用于粉末直接压片。淀粉（D错）常与可压性较好的蔗糖粉、糊精等混合使用。糖粉（E错）系指结晶性蔗糖经低温干燥粉碎后而成的白色粉末，其优点是黏合力强、可用来增加片剂的硬度，缺点是吸湿性较强。